下列关于血友病的说法错误的是
A. 血友病是一组因遗传性凝血活酶生成障碍引起的出血性疾病
B. 包括血友病A、血友病B及遗传性FⅪ缺乏症
C. 以血友病A最为常见
D. 出血轻重仅与血友病类型有关
E. 血友病出血多为自发性或轻度外伤后出血不止

正确答案：D。出血轻重仅与血友病类型有关

解析：出血轻重与血友病类型及相关因子缺乏程度有关。掌握“血友病”知识点。